25-L甾体皂苷的IR特征是
A. 899～894cm-1的吸收强度与920～915cm-1的吸收强度相等
B. 899～894cm-1的吸收强度是920～915cm-1的吸收强度的2倍
C. 899～894cm-1的吸收强度是920～915cm-1的吸收强度的1/2
D. 899～894cm-1的吸收强度是920～915cm-1的吸收强度的3倍
E. 899～894cm-1的吸收强度是920～915cm-1的吸收强度的1/3

正确答案：E。899～894cm-1的吸收强度是920～915cm-1的吸收强度的1/3